预防性树脂充填属于
A. 龋病一级预防
B. 龋病二级预防
C. 龋病三级预防
D. 以上都不是
E. 属于治疗，不是预防

正确答案：B。龋病二级预防

解析：二级预防早期诊断早期处理：定期进行临床检查及X线辅助检查，发现早期龋及时充填。如果牙齿（牙合）面的窝沟点隙有龋损能够卡住探针，证明早期龋损已经发生，故预防性树脂充填属于龋病的二级预防范围。掌握“龋病三级预防”知识点。